会双手传递物品的年龄是
A. 8个月
B. 10个月
C. 15个月
D. 18个月
E. 24个月

正确答案：A。8个月

解析：本题考查精细动作的发育程序。精细动作的发育程序为：6月龄伸手够抓面前的玩具，8月龄（A对BCDE错）会双手传递，9月龄能用拇指、示指对指取小物品。2岁叠6～7块积木，能一页一页地翻书，3岁叠10块积木，会穿珠子。